根据《国家药品监督管理局职能配置、内设机构和人员编制规定》及其有关规定，负责组织开展国家药品标准宣传培训的机构是
A. 国家药品监督管理局高级研修学院
B. 国家药品监督管理局执业药师资格认证中心
C. 国家药典委员会
D. 国家药品监督管理局信息中心

正确答案：C。国家药典委员会

解析：本题考查的是国家药典委员会的主要职责。根据《国家药品监督管理局职能配置、内设机构和人员编制规定》及其有关规定，负责组织开展国家药品标准宣传培训的是国家药典委员会（C对）。国家药典委员会的主要职责：①组织编制、修订和编译《中华人民共和国药典》（以下简称《中国药典》）及配套标准。②组织制定修订国家药品标准。参与拟订有关药品标准管理制度和工作机制。③组织《中国药典》收载品种的医学和药学遴选工作。负责药品通用名称命名。④组织评估《中国药典》和国家药品标准执行情况。⑤开展药品标准发展战略、管理政策和技术法规研究。承担药品标准信息化建设工作。⑥开展药品标准国际（地区）协调和技术交流，参与国际（地区）间药品标准适用性认证合作工作。⑦组织开展《中国药典》和国家药品标准宣传培训与技术咨询，负责《中国药品标准》等刊物编辑出版工作。⑧负责药典委员会各专业委员会的组织协调及服务保障工作。高级研修学院（A错）的主要职责为：①实施公务人员高级研修，承担监管政策理论研究及人才队伍发展战略研究。②承担职业化药品检查员教育培训工作。③承担药品监管系统教育培训研究、课题开发和培训教学实施。④组织开展执业药师考前培训、继续教育、师资培训及相关工作。⑤开展药品安全专业技术人员培训工作。⑥负责药品安全关键岗位从业人员（工种）技能鉴定相关工作。⑦拟定药品监管教育培训相关学科、课程和教材体系建设规划并组织实施。执业药师资格认证中心（B错）的主要职责为：①开展执业药师资格准入制度及执业药师队伍发展战略研究，参与拟订完善执业药师资格准入标准并组织实施。②承担执业药师资格考试相关工作。组织开展执业药师资格考试命审题工作，编写考试大纲和考试指南。负责执业药师资格考试命审题专家库、考试题库的建设和管理。③组织制订执业药师认证注册工作标准和规范并监督实施。承担执业药师认证注册管理工作。④组织制订执业药师认证注册与继续教育衔接标准。拟订执业药师执业标准和业务规范，协助开展执业药师配备使用政策研究和相关执业监督工作。⑤承担全国执业药师管理信息系统的建设、管理和维护工作，收集报告相关信息。⑥指导地方执业药师资格认证相关工作。⑦开展执业药师资格认证国际（地区）交流与合作。⑧协助实施执业药师能力与学历提升工程。国家药品监督管理局信息中心（D错）的主要职责：①承担国家药品监管信息化重点工程、重大项目的申报和实施相关工作。承担国家药品安全监管信息平台建设，组织推进国家药品监管业务应用信息系统建设。②归口管理国家局机关和直属单位网络安全和信息化建设。指导地方药品监管系统信息化相关业务工作。③参与起草国家药品（含医疗器械、化妆品）监管信息化建设发展规划。组织开展药品监管信息政策研究，研究建立国家药品监管信息化标准体系。④负责中国食品药品监管数据中心的建设，承担监管信息数据的采集、整理、存储、分析、利用、监测、评价等管理工作。⑤负责国家局机关电子政务建设，承担国家局机关电子政务信息系统运行维护和网络安全技术保障工作。⑥承担药品监管统计业务工作，健全统计指标体系，开展数据采集、汇总、分析工作，编辑和提供统计资料。⑦研究开发药品信息产品，通过网络、期刊及其他技术交流与合作方式，面向系统、社会和行业开展信息服务。⑧开展药品监管信息相关领域的国际（地区）交流与合作。⑨承办国家局及其网络安全和信息化领导小组交办的其他事项。